何者不是舌下面的结构
A. 舌系带
B. 伞襞
C. 舌下阜
D. 舌下襞
E. 舌盲孔

正确答案：E。舌盲孔

解析：舌系带(A错)为舌下面的一条黏膜皱襞，伞襞(B错)由舌结构图可知在舌下，为在舌系带两边的黏膜皱襞，舌下阜(C错)为舌系带根部两侧的黏膜隆起，舌下襞(D错)为舌下阜向口底后外侧延续的带状黏膜皱襞，舌盲孔(E对)为V形界沟尖端的小凹，在舌背上而不在舌下。